强心苷类药物地高辛安全、有效的血药浓度是
A. 1～5㎍/ml
B. 5～10ng/ml
C. 5～20㎍/ml
D. 0.5～1ng/ml
E. 20～40㎍/ml

正确答案：D。0.5～1ng/ml

解析：本题考查地高辛的使用。地高辛的安全有效的浓度为0.5～1ng/ml（D对）。